传播活动经常不是指通过一种媒介开展，往往选择和使用多种媒介，这样就能获得更好的效果。例如，使用一种可以获得65％传播效果的传媒，再使用另一种可以获得60％传播效果的传媒，那么，两者共同传播获得的效果是
A. 比两者都高
B. 比两者都低
C. 与两者相同
D. 与前者相同
E. 与后者相同

正确答案：A。比两者都高